首选腹腔镜胆囊切除术的是慢性胆囊炎合并
A. 妊娠
B. 胆囊多发结石
C. 胆道狭窄
D. 胆囊癌可能
E. 腹腔内粘连严重

正确答案：B。胆囊多发结石

解析：首选腹腔镜胆囊切除术的是慢性胆囊炎合并胆囊多发结石（B对）。